支配瞳孔开大肌的神经是
A. 动眼神经的躯体运动纤维
B. 耳神经节的交感节后纤维
C. 下颌下神经节的交感节后纤维
D. 以上都不是
E. 无

正确答案：D。以上都不是

解析：动眼神经的躯体运动纤维（A错）支配眼内肌的运动。耳神经节的交感后纤维（B错）控制腮腺的分泌。下颌下神经节的交感节后纤维（C错）控制舌下腺和下颌下腺的分泌。睫状神经节的交感根进入眼球后支配瞳孔开大肌和眼球血管，选项中无正确答案（D对）。